患儿，7岁。反复脐周疼痛半年，发作加重一天，纳差，食入即吐，大便2日未行，腹胀满，扪之有团块，舌苔黄腻。治疗首选
A. 大承气汤
B. 小承气汤
C. 增液承气汤
D. 驱蛔承气汤
E. 调胃承气汤

正确答案：D。驱蛔承气汤

解析：蛔虫数量多时，缠结成团，阻塞肠中，使传化不行，则腑气不通而成“虫瘕”证。虫瘕证除具有蛔虫证的一般症状外，突然脐腹阵发性剧烈疼痛，频繁呕吐，或呕蛔虫，便秘，腹胀，腹部可扪及质软、无痛的可移动包块。病情持续不缓解者，见腹硬、压痛明显，肠鸣，无矢气。舌苔白或黄腻，脉滑数或弦数（D对）。大承气汤具有峻下热结之功效，主治阳明腑实证，大便不通，频转矢气，脘腹痞满，腹痛拒按，按之则硬，甚或潮热谵语，手足濈然汗出，舌苔黄燥起刺，或焦黑燥裂，脉沉实；热结旁流证，下利清谷，色纯青，其气臭秽，脐腹疼痛，按之坚硬有块，口舌干燥，脉滑实；里热实证之热厥、痉病或发狂等（A错）。小承气汤轻下热结，谵语潮热，大便秘结，主治痘疹后胃弱不能胜谷，谓之食蒸发搐。其人潮热，大便酸臭，秘泄不调，或呕吐肠痛（B错）。增液承气汤具有滋阴增液，泻热通便之功效。主治热结阴亏证。燥屎不行，下之不通，脘腹胀满，口干唇燥，舌红苔黄，脉细数（C错）。调胃承气汤缓下热结，治疗阳明病胃肠燥热证，大便不通，肠梗阻，口渴心烦，蒸蒸发热，或腹中胀满，或为谵语，舌苔正黄，脉滑数；以及胃肠热盛而致发斑吐衄，口齿咽喉肿痛等（E错）。